早期新生儿指的是
A. 出生时胎龄满37+0～41+6周的新生儿
B. 出生时胎龄37周的新生儿
C. 出生1周以内的新生儿
D. 出生第2～4周的新生儿
E. 出生时胎龄≥42周的新生儿

正确答案：C。出生1周以内的新生儿